男，40岁。半年来左上后牙遇冷热痛，但无自发痛，近1月来，除冷热过敏外隐隐作痛。近1周出现自发痛，阵发加剧，夜间痛。检查发现左上第二磨牙近中（牙合）面龋深穿髓，探痛明显，叩痛（±）。主诉牙最有可能的诊断是急性牙髓炎，主诉牙有效的处理方法是
A. 消炎止痛
B. 局部上药
C. 龋洞充填
D. 牙髓治疗
E. 牙周治疗

正确答案：D。牙髓治疗

解析：本题考查急性牙髓炎的应急处理。该主诉牙为急性牙髓炎，急性牙髓炎应急处理的目的是引流炎症渗出物和缓解因之而形成的髓腔高压，以减轻剧痛。其处理方法为局麻下穿通髓腔，摘除牙髓，去除全部或大部分牙髓，即牙髓治疗（D对），然后放置一无菌小棉球后暂封髓腔。消炎止痛（A错）和局部上药（B错）只能缓解疼痛，达不到根治的效果。龋洞充填（C错）适用于牙髓未受感染的情况，主诉牙为急性牙髓炎，应该在行根管治疗之后再充填龋洞。牙周治疗（E错）适用于主诉牙有牙周组织疾病的情况，但牙周治疗并不能有效地缓解急性牙髓炎的疼痛。